从慢性病自然史的6个阶段与危险因素作用的关系可以看出，目前临床医学的重点一般起始于疾病的第几个阶段
A. 1
B. 2
C. 3
D. 4
E. 5

正确答案：D。4